某单位从1985年起对职工心脏病的发病情况进行研究。在1985年每位职工填写了一份关于体育锻炼的调查表，然后对其随访直至2000年。研究者发现：对于调查表中填有每天有规律地锻炼30分钟的职工，在总共4000个观察人年中发生心脏病50例，而锻炼没有规律的职工，在总共3000个观察人年中发生心脏病200例。测量职工心脏病发病危险最合适的指标是
A. 累积发病率
B. 发病密度
C. 标准化发病率
D. 年发病危险
E. 标化发病比

正确答案：B。发病密度

解析：本题考查发病密度。发病密度（B对ACDE错）以观察人时为分母计算发病率，用人时为单位计算出来的率带有瞬时频率性质。